急性浆液性根尖周炎与急性化脓性根尖周炎的主要区别点是
A. 患牙咬合痛
B. 自发性、持续性钝痛
C. 有持续性跳痛
D. 患牙松动
E. 叩诊疼痛明显

正确答案：C。有持续性跳痛

解析：本题考查急性浆液性根尖周炎与急性化脓性根尖周炎的鉴别。急性根尖周炎的发生发展是一个连续的过程，一般经历从浆液期到化脓期。在浆液期，患牙以咬合痛为突出表现，发展至化脓期，才会出现有持续性跳动（C对）。但是不管在哪一个阶段患牙咬合痛（A错）、自发性、持续性钝痛（B错）、患牙松动（D错）、叩诊疼痛明显（E错）的症状都持续存在，不能作为二者的鉴别点。